下列哪一项不属阿托品的不良反应
A. 口干舌燥
B. 恶心呕吐
C. 心动过速
D. 皮肤潮红
E. 视近物模糊

正确答案：B。恶心呕吐

解析：阿托品属于M受体阻断药，小剂量的阿托品（0.32004U2-0.5mg）即能明显抑制唾液腺与汗腺的分泌，引起口干和皮肤干燥（A对）。同时也引起泪腺以及呼吸道分泌大为减少，大剂量还可抑制胃液分泌，不会引起恶心、呕吐（B错，为本题正确答案）。阿托品能解除迷走神经对心脏的抑制，引起心率加快，出现心悸（C对）的不良反应。阿托品有扩张小血管的作用，治疗量对血管无明显影响，较大剂量可解除外周及内脏小血管的痉挛，尤以皮肤血管的扩张最显著，可引起皮肤潮红（D对）、温热等症状。阿托品具有调节麻痹的作用，能使睫状肌松弛退向外缘，悬韧带向周围拉紧，晶状体变扁，屈光度降低，近距离物体不能清晰地成像于视网膜上，看近物模糊不清（E对），而只能够看远物。